具有精血同源关系的是
A. 心与肺
B. 心与脾
C. 心与肝
D. 心与肾
E. 肝与肾

正确答案：E。肝与肾

解析：该题考查精与血关系以及脏与脏的关系。肾藏精，肝藏血，精能生血，血可化精，这种精血之间相互滋生，相互转化的关系即可称为“精血同源”也可称为“肝肾同源”（E对）。心与肺的关系主要表现在血液运行与呼吸吐纳之间的协调关系（A错）。心与脾的关系，主要表现在血液生成方面的相互为用及血液运行方面的相互协同（B错）。心与肝的关系，主要表现在行血及藏血以及精神调节两个方面（C错）。心与肾再生理上的联系主要表现为“心肾相交”（D错）。